银汞合金充填（牙合）面洞3日有激发痛与自发性隐痛，可能是因为
A. 咬合创伤
B. 有小穿髓点未发现
C. 基底过薄
D. 洞较深未加基底

正确答案：B。有小穿髓点未发现

解析：本题考查充填后疼痛。银汞合金充填（牙合）面洞3日有激发痛与自发性隐痛，可知充填后短时间内出现自发性痛、激发痛，此种情况应考虑有牙髓炎的可能，一般由于牙体预备时意外穿髓，形成小的穿髓孔未及时发现（B对），直接充填，充填后牙髓感染发展成牙髓炎，出现激发痛和自发性隐痛。咬合创伤可引起咬合痛（A错）。基底过薄（C错）、洞较深未加基底（D错），温度刺激可传导至牙髓，出现冷热刺激痛，但无自发痛。